用一种筛检乳腺癌的试验，对400例患有乳腺癌的妇女和400名正常妇女进行筛检，结果前者中80例阳性，后者中40例阳性。该试验的特异度为
A. 0.8
B. 0.2
C. 0.5
D. 0.9
E. 0.1

正确答案：D。0.9

解析：根据表6-2 评价试验的整理表，该实验中病例数（a+c）为400例患有乳腺癌的妇女，a为80例阳性的患有乳腺癌的妇女，可得c为320名阴性的患有乳腺癌的妇女，非病例数（b+d）为400名正常妇女，b为40例阳性的正常妇女，可得d为360名阴性的正常妇女。根据以上数据，结合特异度计算公式，可以得出特异度=d/b+d ×100%=90%（D对），假阳性率=b/b+d ×100%=10%（E错），灵敏度= a/a+c ×100%=20%（B错），假阴性率= c/a+c ×100%=80%（A错）。